与五行中“水”相对应的是
A. 脉、心
B. 筋、肝
C. 思、脾
D. 燥、肺
E. 耳、骨

正确答案：E。耳、骨

解析：本题考查的是事物属性的五行归类。与五行中“水”相对应的是耳、骨（E对）。人体中五脏：肝、心、脾、肺、肾；五腑：胆、小肠、胃、大肠、膀胱；五官：目、舌、口、鼻、耳；形体：筋、脉、肉、皮、骨；情志：怒、喜、思、悲、恐；五声：呼、笑、歌、哭、呻；变动：握、忧、哕、咳、栗分别与五行木、火、土、金、水对应。自然界中五音：角、徵、宫、商、羽；五味：酸、苦、甘、辛、咸；五色：青、赤、黄、白、黑；五化：生、长、化、收、藏；五气：风、暑、湿、燥、寒；方位：东、南、中、西、北；季节：春夏、长夏四时、秋、冬分别与五行木、火、土、金、水对应。故脉、心（A错）与五行中“火”相对应。筋、肝（B错）与五行中“木”相对应。思、脾（C错）与五行中“土”相对应。燥、肺（D错）与五行中“金”相对应。